下列属于尖牙保护（牙合）中尖牙的有利条件的是
A. 尖牙具有适合制导的舌面窝，可导致（牙合）力趋于轴向
B. 尖牙根长且粗大，支持力强
C. 尖牙位居牙弓前部，在咀嚼时构成第Ⅲ类杠杆，能抵御较大的咀嚼力
D. 牙周韧带感受器丰富，对刺激敏感，能及时调整反应
E. 以上都是

正确答案：E。以上都是

解析：尖牙保护（牙合）中尖牙的有利条件：①尖牙具有适合制导的舌面窝，可导致（牙合）力趋于轴向；②根长且粗大，支持力强；③尖牙位居牙弓前部，在咀嚼时构成第Ⅲ类杠杆，能抵御较大的咀嚼力；④牙周韧带感受器丰富，对刺激敏感，能及时调整反应。掌握“（牙合）分类及临床意义与面部结构”知识点。